下列关于固定桥连接体的说法中正确的是
A. 不是固定桥结构中的应力集中区
B. 为增加强度连接体应向龈端延伸至龈缘处
C. 都是整体铸造而成
D. 连接体的外形应圆钝
E. 连接体的截面积小于4mm2

正确答案：D。连接体的外形应圆钝

解析：答案A不是固定桥结构中的应力集中区，说法错误，固定桥结构的应力集中区在连接体处，基牙及支持组织的应力集中区在基牙颈周骨皮质处、基牙根尖处、牙槽嵴顶处、旋转中心处。答案B错误，固定桥的连接体位于基牙的近中或远中面，相当于天然牙的邻面接触区，所以连接体的四周应圆钝和高度抛光，形成正常的唇颊、舌腭外展隙和邻间隙。答案C固定桥连接体分为固定连接体、活动连接体。其中固定连接体的制作工艺可以是整体铸造连接也可以是焊接连接。答案E固定连接体相当于天然牙的邻面接触区，其截面积为4～10mm2。掌握“固定桥的设计”知识点。